3岁患儿，高热10小时，伴头痛，频繁呕吐，腹泻3次为稀水样便。查体：T39℃，BP50／30mmHg，精神萎靡，全身散在大小不等瘀斑，心肺未见异常。CSF检查：细胞数15000×10⁶／L，蛋白微量，葡萄糖2.2mmol／L，该患儿可能的诊断是
A. 败血症，感染性休克
B. 流行性脑脊髓膜炎
C. 流行性乙型脑炎
D. 中毒型细菌性痢疾
E. 化脓性脑膜炎

正确答案：B。流行性脑脊髓膜炎

解析：患儿有发热症状，头痛、呕吐提示颅内压升高；血压下降，查体全身散在瘀斑；CSF提示细胞数大量增多，葡萄糖降低。根据以上依据可诊断为流行性脑脊髓膜炎（B对）。流行性脑脊髓膜炎是由脑膜炎奈瑟菌引起的急性化脓性脑膜炎，是化脓性脑膜炎的一种，在败血症期广泛出现瘀斑为流脑区别于其他化脓性脑膜炎的特异体征，取皮肤瘀点处的组织液行涂片菌检，阳性率可达60%~80%（E错）。